细菌大量人血并繁殖，称为
A. 败血症
B. 毒血症
C. 内毒素血症
D. 脓毒血症
E. 菌血症

正确答案：A。败血症